肾绞痛伴镜下血尿，常见的病因是
A. 肾结石
B. 肾肿瘤
C. 肾囊肿
D. 肾炎
E. 肾结核

正确答案：A。肾结石

解析：阵发性肾绞痛伴镜下血尿是肾（A对）和输尿管结石的典型表现。肾肿瘤（B错）主要表现为无痛性肉眼血尿、腰痛和腹部肿块。肾囊肿（C错）早期一般无明显表现，其诊断主要依靠影像学检查。肾炎（D错）主要表现为血尿、蛋白尿、高血压、水肿。肾结核（E错）典型表现为尿频、尿急、尿痛伴终末血尿，可有低热、盗汗等结核中毒症状。